患者沈某患肠癌，对其进行手术治疗，手术中因医生误伤其动脉，患者需要输血，此时错误的说法是
A. 使用医院储备血液，如无储备则需从血站取血
B. 因情况紧急，医院也可临时采血，但要符合相关规定和要求
C. 使用血站提供的无偿献血血液，患者无需交纳任何费用
D. 如果医院在输血过程中尽到了注意义务，没有出现任何差错，患者仍因输血而感染某种疾病，则此事件不属于医疗事故
E. 从血站取来的无偿鲜血血液手术使用剩余部分医院不得出售给血液制品生产单位

正确答案：C。使用血站提供的无偿献血血液，患者无需交纳任何费用

解析：本题考查《献血法》。患者沈某患肠癌，对其进行手术治疗，手术中因医生误伤其动脉，患者需要输血。《献血法》第十四条规定，公民临床用血时只交付用于血液的采集、储存、分离、检验等费用；具体收费标准由国务院卫生行政部门会同国务院价格主管部门制定。无偿献血者临床需要用血时，免交前款规定的费用；无偿献血者的配偶和直系亲属临床需要用血时，可以按照省、市、自治区、直辖市人民政府的规定免交或者减交前款规定的费用（C错，为本题的正确答案）。《献血法》规定，医疗机构对临床用血必须进行核査，医疗机构不得将不符合国家规定标准的血液用于临床（A对）。《献血法》规定，为保证应急用血，医疗机构可以临时采集血液，但应当依照规定、确保采血用血安全（B对）。《医疗事故处理条例》规定了6种情形不属于医疗事故：①在紧急情况下为抢救垂危患者生命而采取紧急医学措施造成不良后果的；②在医疗活动中由于患者病情异常或者患者体质特殊而发生医疗意外的；③在现有医学科学技术条件下，发生无法预料或者不能防范的不良后果的（D对）；④无过错输血感染造成不良后果的；⑤因患方原因延误诊疗导致不良后果的；⑥因不可抗力造成不良后果的。《献血法》规定，无偿献血的血液必须用于临床，不得买卖。血站、医疗机构不得将无偿献血的血液出售给单采血浆站或者血液制品生产单位（E对）。